硫酸庆大霉素注射液含量测定应采用的方法是
A. 红外分光光度法
B. 紫外-可见分光光度法
C. 分子排阻色谱法
D. 高效液相色谱法
E. 抗生素微生物检定法

正确答案：E。抗生素微生物检定法

解析：本题考查抗生素类药物的含量测定。《中国药典》采用微生物法测定硫酸庆大霉素的含量，硫酸庆大霉素制剂的含量测定与原料药相同，均采用抗生素微生物检定法（E对）。高效液相色谱法（D错）用于测定庆大霉素C各组分的含量。